临床手术与麻醉的特点不包括
A. 损伤的必然性
B. 技术的复杂性
C. 患者的被动性及术前的焦虑心理
D. 患者或家属的多项要求
E. 过程中的风险性

正确答案：D。患者或家属的多项要求